对孕妇进行访视、询问并记录她怀孕期间的吸烟情况，而后分析吸烟暴露与婴儿低出生体重的关系，这种研究的类型是
A. 现况调查
B. 临床研究
C. 现场试验
D. 队列研究

正确答案：D。队列研究

解析：本题考查队列研究的概念。队列研究（D对ABC错）是将人群按是否暴露于某可疑因素及其暴露程度分为不同组，追踪其各组的结局，比较不同组之间结局频率的差异，从而判定暴露因素与结局之间有无因果关联及关联大小的一种观察性研究方法。对孕妇进行访视、询问并记录她怀孕期间的吸烟情况，而后分析吸烟暴露与婴儿低出生体重的关系的研究属于队列研究。